B环在3位的是
A. 橙酮
B. 异黄酮
C. 黄酮醇
D. 二氢黄酮
E. 黄烷

正确答案：B。异黄酮

解析：本题考查的是黄酮类化合物的主要结构类型。B环在3位的是异黄酮（B对）。异黄酮类的B-环在3-位。橙酮（A错）、黄酮醇类（C错）、二氢黄酮（D错）、黄烷（E错）的B-环均在2-位。